以下哪些措施不是幼儿心理保健的主要措施
A. 建立正确的自我意识
B. 通过游戏进行学习
C. 提供温暖和睦的家庭环境
D. 注意断乳期的辅食添加
E. 保持和培养独立性、自尊心和自信心

正确答案：D。注意断乳期的辅食添加

解析：本题考查幼儿心理保健的主要措施。断乳期的辅食添加（D错，为本题正确答案）属于6～12月龄婴儿的膳食保健措施，不是幼儿心理保健措施。幼儿心理保健的主要措施包括：1.建立幼儿正确的自我意识（A对）；2.通过游戏进行学习（B对）；3.提供幼儿温暖和睦的家庭环境（C对）；4.保持和培养幼儿的独立性、自尊心和自信心（E对）。